CRH神经元散布于从大脑皮质到脊髓的广泛脑区，但最主要位于
A. 室旁核
B. 杏仁体
C. 海马结构
D. 边缘皮层
E. 蓝斑

正确答案：A。室旁核

解析：室旁核（A对）是CRH神经元分布的主要部位。